“子处”又称
A. 血海
B. 血室
C. 胞络
D. 胞脉
E. 天癸

正确答案：B。血室

解析：子宫，古人称之为女子胞，又称胞宫、胞脏、子脏、子处、子宫、血室，系孕育胚胎、胎儿和产生月经的器官（B对）。冲脉为血海（A错），胞脉又名胞络（CD错），联系胞宫的经络，主要是八脉中的冲脉和任脉，因这两条经脉均起于胞中，与女子的月事、妊娠有直接关系。天癸（E错）是肾中精气充盈到一定程度时产生的具有促进人体生殖器官成熟，并维持生殖机能的物质。